下列各项，不宜应用溻渍法的是
A. 阳证疮疡初起
B. 阳证疮疡成脓
C. 阳证疮疡溃后
D. 半阴半阳证疮疡
E. 阴证疮疡

正确答案：B。阳证疮疡成脓

解析：溻渍法是指通过湿敷、淋洗、浸泡对患处的物理作用，以及不同药物对患部的药效作用而达到治疗目的的一种方法，其中，溻是将饱含药液的纱布或棉絮湿敷患处，渍是将患处浸泡在药液中。适用于阳证疮疡初起、溃后（AC对）；半阴半阳证及阴证疮疡（DE对）；美容、保健等（B错，为本题正确答案）。